髁突骨折无移位治疗方法正确的是
A. 颅牙合弹性牵引
B. 磨牙区垫2-3mm的橡皮垫，颌间弹性牵引固定
C. 手术治疗
D. 手法复位
E. 观察

正确答案：B。磨牙区垫2-3mm的橡皮垫，颌间弹性牵引固定

解析：本题考查髁突骨折的治疗。髁突骨折无移位治疗常在磨牙区垫2～3mm的橡皮垫，颌间弹性牵引固定（B对）。此方法即使移位的髁突未能完全复位，在愈合过程中可发生吸收与改建，随着功能的需要，髁突出现适应性变化而不影响功能。颅颌弹性牵引（A错）主要用于上颌骨骨折。手术治疗（C错）：主要用于有开放性创口的骨折、闭合性颌骨复杂骨折或己有错位愈合的陈旧性骨折。手法复位（D错）：主要用于新鲜骨折并且移位不大的线形骨折。观察（E错）不符合髁突骨折的治疗。